用手用器械清除龋坏组织，然后用有黏结性、耐压和耐磨性能较好的新型玻璃离子材料将龋洞充填的技术称为
A. 预防性树脂充填
B. 非创伤性修复
C. 点隙裂沟封闭
D. 烤瓷熔附金属全冠修复
E. 嵌体预备

正确答案：B。非创伤性修复

解析：非创伤性修复治疗是指使用手用器械清除龋坏组织，然后用有黏结性、耐压和耐磨性能较好的新型玻璃离子材料将龋洞充填的技术。掌握“非创伤性修复治疗”知识点。